女，68岁。上腹部不适1个月，伴皮肤黄染、食欲不振、厌油腻饮食，体重减轻5kg。查体：巩膜明显黄染，肝肋下未触及，右肋缘下可触及肿大的胆囊底部，无触痛。实验室检查：血胆红素340μmol/L。首先考虑的诊断是
A. 肝癌
B. 胆总管结石
C. 胆囊结石
D. 胃癌
E. 胆管癌

正确答案：E。胆管癌

解析：老年女性患者，上腹部不适、食欲不振及体重减轻，体格检查见巩膜明显黄染，血胆红素340μmol/L（成人正常值为3.4～17.1μmol/L，171～342μmol/L为中度黄疸），可触及无痛的肿大胆囊（Courvoisier征的出现一般提示胆总管下段癌或胰头癌、壶腹周围癌），根据临床表现及相应的检查，首先考虑的诊断是胆管癌（E对）或胰头癌。胆总管下段癌阻塞胆管，胆汁排出受阻，使得患者出现黄疸、胆囊显著肿大。肝癌（P418）（A错）的主要表现为肝区疼痛及乏力、消瘦等全身症状，体格检查时可触及增大的肝脏。胆总管结石（P440）（B错）主要表现为腹痛、黄疸、腹膜刺激征等，不会出现体重减轻等肿瘤的全身性表现。胆囊结石（C错）一般无黄疸，主要表现为饱餐后右上腹绞痛。胃癌（D错）症状多为无特异性的消化道症状，不出现黄疸。